以下杂质检查的条件是：硫酸盐
A. 在盐酸酸性条件下检查
B. 在硝酸酸性条件下检查
C. 在醋酸盐缓冲液（pH3.5）中检查
D. 在硫酸酸性条件下检查
E. 在磷酸盐缓冲液（pH6.8）中检查

正确答案：A。在盐酸酸性条件下检查